病因网（络）模型的主要优点是
A. 涉及的病因链较多且相互交错
B. 涉及的因素清晰具体且系统性强
C. 没有确定必要病因的困难
D. 没有确定充分病因的困难
E. 涉及因素具体且可操作性强

正确答案：B。涉及的因素清晰具体且系统性强

解析：本题考查病因网（络）模型的主要优点。病因网（络）模型的主要优点是涉及的因素清晰具体且系统性强（B对ACDE错）。